使基础代谢率增高的主要激素是
A. 糖皮质激素
B. 肾上腺素
C. 雌激素
D. 甲状腺激素
E. 甲状旁腺激素

正确答案：D。甲状腺激素